邪热过盛伏阳于里，不能透达于外的病理状态是
A. 阴损及阳
B. 阳损及阴
C. 阴阳亡失
D. 阳盛格阴
E. 阴盛格阳

正确答案：D。阳盛格阴

解析：本题考查的是阳盛格阴的定义。邪热过盛伏阳于里，不能透达于外的病理状态是阳盛格阴（D对）。阴阳失调，即是阴阳消长失去平衡协调的简称。是指机体在疾病的发生发展过程中，由于各种致病因素的影响，导致机体阴阳消长失去相对的平衡，从而形成阴阳偏盛、偏衰，或阴不制阳、阳不制阴的病变状态。阴阳失调病机，是以阴阳的属性，阴和阳之间所存在的相互制约、相互消长、互根互用和相互转化的理论，来阐释、分析、综合机体一切病变现象的机制，形成了阴阳偏盛偏衰、阴阳互损、阴阳格拒、阴阳亡失等病机的概念及以寒热变化为主的证候。1.阴阳偏盛：又称“阴阳偏胜”，阴或阳的偏盛，主要是指“邪气盛则实”的实证。2.阴阳偏衰：阴或阳的偏衰，是指“精气夺则虚”的虚证。“精气夺”，实质上是包括了机体的精、气、血、津液等基本物质的不足及其生理功能的减退，同时也包括了脏腑、经络等生理功能的减退和失调。3.阴阳互损：阴阳互损，是指阴或阳任何一方虚损到相当程度，病变发展影响及相对的一方，形成阴阳两虚的病变机制。（1）阴损及阳（A错）：阴损及阳，是指由于阴气亏损，累及阳气生化不足，或阳气无所依附而耗散，从而在阴虚的基础上又出现了阳虚，形成以阴虚为主的阴阳两虚的病机变化。（2）阳损及阴（B错）：阳损及阴，是指由于阳气虚损，无阳则阴无以生，从而在阳虚的基础上又导致了阴虚，形成以阳虚为主的阴阳两虚的病机变化。4.阴阳格拒：阴阳格拒，是阴阳失调病机中比较特殊的一类病机。（1）阴盛格阳（E错）：阴盛格阳，是指阴寒之邪壅盛于内，逼迫阳气浮越于外，使阴阳之气不相顺接、相互格拒，表现为真寒假热的病机变化。（2）阳盛格阴：阳盛格阴，是指邪热过盛，深伏于里，阳气被遏，郁闭于内，不能外透布达于肢体，从而形成阴阳排斥，而格阴于外，表现为真热假寒的病机变化。5.阴阳亡失（C错）：阴阳亡失是机体的阴液或阳气突然大量地亡失，导致生命垂危的一种病变状态。